下列不属于卫生服务利用指标的是
A. 两周每千人就诊次数
B. 两周就诊率
C. 每人每年就诊次数
D. 每千人因病卧床天数
E. 一年内每千人住院日数

正确答案：D。每千人因病卧床天数